苦参总生物碱具有
A. 发汗平喘作用
B. 抗菌作用
C. 镇痛作用
D. 镇静麻醉作用
E. 消肿利尿、抗肿瘤作用

正确答案：E。消肿利尿、抗肿瘤作用